抑制平滑肌和心肌细胞Ca²⁺内流的降压药是
A. 利舍平
B. 氢氯噻嗪
C. 硝苯地平
D. 肼屈嗪
E. 可乐定

正确答案：C。硝苯地平

解析：本题考查药物的作用机制。抑制平滑肌和心肌细胞Ca²⁺内流的降压药是硝苯地平（C对）。硝苯地平主要作用于细胞膜上的钙通道，通过抑制钙离子从细胞外进入细胞内，而使细胞内钙离子浓度降低，导致小动脉扩张，总外周血管阻力下降而降低血压。利舍平（A错）主要影响交感神经末梢去甲肾上腺素的摄入，耗尽去甲肾上腺素的储存，阻断交感神经冲动的传递，从而使血管舒张，血压下降。氢氯噻嗪（B错）主要是通过抑制远端小管前段和近端小管对氯化钠的重吸收，从而增加远端小管和集合管的钠钾离子交换，使钾离子分泌增多。肼屈嗪（D错）通过直接松弛小动脉平滑肌，降低外周阻力而降压。可乐定（E错）抑制交感神经活性，减少心排血量和降低外周阻力而降压，作用中等偏强。